脑出血患者出现典型三偏征伴同向偏视，最可能的出血部位是
A. 壳核出血
B. 丘脑出血
C. 脑桥出血
D. 小脑出血
E. 脑叶出血

正确答案：A。壳核出血

解析：脑出血患者出现典型三偏征伴同向偏视，最可能的出血部位是壳核出血（A对），丘脑出血（B错）约占ICH病例的10%-15% 常有对侧偏瘫、偏身感觉障碍，通常感觉障碍重于运动障碍。深浅感觉均受累，而深感觉障碍更明显。可有特征性眼征，如上视不能或凝视鼻尖、眼球偏斜或分离性斜视、眼球会聚障碍和无反应性小瞳孔等。脑桥出血（C错）大量时表现为立即昏迷、呕吐、高热、去大脑强直等，小量出血时表现为表现为交叉性瘫痪和共济失调性偏瘫。小脑出血（D错）常有头痛、呕吐，眩晕和共济失调明显，起病突然，可伴有枕部疼痛。脑叶出血（E错）根据出血位置不同有不同的临床表现，但是很少同时出现偏瘫、偏盲偏身感觉障碍。